除一项外，以下措施都是发生自然灾害时的卫生要求或措施
A. 灾区提倡饮用水必须消毒，尽量饮用煮开的水
B. 灾民临时安置点应选择地势较高、向阳、通风、干燥、水源丰富排水方便地方
C. 肠道传染病患者的粪便必须用专用容器收集，然后作特殊消毒处理
D. 为尸体掩埋后尽快地腐败分解，减少尸臭，掩埋坑要撒布大量漂白粉
E. 灾区的生活垃圾和医疗垃圾，可采取焚烧、填埋方法处理

正确答案：D。为尸体掩埋后尽快地腐败分解，减少尸臭，掩埋坑要撒布大量漂白粉

解析：本题考查发生自然灾害时的卫生要求或措施。发生自然灾害时的卫生要求或措施包括：1.灾区提倡饮用水必须消毒，尽量饮用煮开的水（A对）；2.灾民临时安置点应选择地势较高、向阳、通风、干燥、水源丰富排水方便地方（B对）；3.肠道传染病患者的粪便必须用专用容器收集，然后作特殊消毒处理（C对）；4.灾区的生活垃圾和医疗垃圾，可采取焚烧、填埋方法处理（E对）。为了取得较好效果，尸体除臭常常采用感官、物理和化学综合除臭法（D错，为本题正确答案）。